男，60岁。水肿、蛋白尿3个月。既往患糖尿病3年，高血压2年，实验室检查：ESR43mm/h，Hb80g/L，TP79g/L，AIb30g/L，SCr152µmoI/L。尿沉渣镜检RBC0~2/HP，尿蛋白（＋）。尿蛋白定量7.6g/24h，尿蛋白分析提示以小分子蛋白为主。该患者最可能的诊断是
A. 多发性骨髓瘤肾损害
B. 糖尿病肾病
C. 乙型肝炎病毒相关性肾炎
D. 良性小动脉性肾硬化症
E. 原发性小血管炎肾损害

正确答案：A。多发性骨髓瘤肾损害

解析：老年男性患者，既往高血压，水肿、蛋白尿，ESR加快，Hb减少（贫血），TP（总蛋白）偏高，AIb（白蛋白）减少，SCr增多，尿蛋白（＋），尿蛋白定量7.6g/24h，以小分子蛋白（本周蛋白）为主。该患者最可能的诊断是多发性骨髓瘤肾损害（A对）。糖尿病肾病（B错）好发于中老年，肾病综合征常见于病程10年以上的糖尿病病人。乙型肝炎病毒相关性肾炎（C错）多见于儿童及青少年，血清乙型肝炎病毒抗原阳性，临床主要表现为蛋白尿或肾病综合征。良性小动脉性肾硬化症（D错）为原发性高血压引起的继发性肾损害，先有较长期高血压病史（5-10年）后再出现肾损害，临床上远曲小管功能损伤（如尿浓缩功能减退、夜尿增多）多较肾小球功能损伤早，尿改变轻微（微量至轻度蛋白尿＜2.0g/24h，以中、小分子蛋白为主，可有轻度镜下血尿），常有高血压的其他靶器官（心、脑）并发症和眼底改变（P479）。